青少年牙周炎的特点为
A. 青少年女性多发
B. 牙石多
C. 牙龈炎症重
D. 好发于尖牙
E. 牙槽骨多为水平吸收

正确答案：A。青少年女性多发

解析：本题考查局限型侵袭性牙周炎的临床表现。青少年牙周炎的特点为青少年女性多发（A对）。青少年牙周炎现称为局限型侵袭性牙周炎，好发于青春期前后，女性多发。牙周组织破坏程度与局部刺激物的量不成比例，即牙石菌斑少（B错），牙龈炎症轻（C错），但已有深牙周袋和牙槽骨破坏。好发于第一恒磨牙和上下切牙，多左右对称，而不是尖牙（D错）。牙槽骨吸收局限于第一恒磨牙和切牙，第一磨牙的邻面表现为垂直型骨吸收，切牙区表现为水平型骨吸收，因此垂直型和水平型骨吸收都有，牙槽骨多为水平吸收（E错）的说法是错误的。